前囟闭合过迟可见于
A. 甲状腺功能减退
B. 佝偻病
C. 脑积水
D. 克汀病
E. 以上都可

正确答案：E。以上都可

解析：前囟出生时约1.0～2.0cm，1～2岁时闭合。前囟闭合过早见于头小畸形，闭合过迟见于佝偻病、甲状腺功能减退和脑积水等。克汀病是一种呆小症，其发病原因是小儿甲状腺功能不足所致。掌握“骨骼发育”知识点。